肾衰患者应大大减量，必须实施治疗药物监测的是
A. 萘啶酸
B. 庆大霉素
C. 黄连素
D. 异烟肼
E. 利福平

正确答案：B。庆大霉素